附着水平的位置与釉牙骨质界相距超过多少时牙周治疗预后较差
A. 1mm
B. 2mm
C. 3mm
D. 4mm
E. 5mm

正确答案：D。4mm

解析：本题考查牙周病的预后。附着水平的位置与釉牙骨质界的距离即附着丧失越大，牙周治疗预后越差。当骨吸收程度达到中度骨吸收，此时附着丧失约3～4mm，牙松动度Ⅱ度，牙松动度较大，牙周袋深，治疗器械难以到达病变处以有效清除菌斑和牙石，所以附着丧失超过4mm（D对）时牙周治疗预后较差。附着丧失1～3mm（ABC错）牙槽骨吸收少，牙周袋浅便于清除袋内菌斑和牙石，预后较好。附着丧失≥5mm（E错），牙槽骨吸收已经较多，牙松动度明显预后无望。